以下不是白血病临床表现的是
A. 贫血
B. 发热
C. 咳嗽
D. 出血
E. 器官和组织浸润的表现

正确答案：C。咳嗽

解析：本题考查急性白血病。咳嗽（C错，为本题正确答案）不是白血病临床表现。白血病临床表现：①贫血（A对）：常为首发表现，进行性加重。②发热（B对）：白血病本身虽然可以发热，但是较高发热往往提示有继发感染。③出血（D对）：可发生于全身各部位，颅内出血是常见死亡原因。④器官和组织浸润的表现（E对）：淋巴结和肝脾大；骨和关节疼痛和压痛，常有胸骨中下段压痛；牙龈和皮肤浸润；中枢神经系统白血病；睾丸无痛性肿大。